脑室造影见侧脑室除下角外均显影良好，考虑病变可能位于
A. 岛叶
B. 额叶
C. 顶叶
D. 枕叶
E. 颞叶

正确答案：E。颞叶

解析：侧脑室位于大脑半球内，延伸至半球的各脑叶内。中央部位于顶叶（C错）；前角伸向额叶（B错）；后角伸入枕叶（D错）；下角最长伸到颞叶内。因而脑室造影见侧脑室除下角外均显影良好，考虑病变可能位于颞叶（E对）。